某患者，牙体缺损，现行PFM全冠修复，PFM全冠肩台的宽度为
A. 0.5mm
B. 1.0mm
C. 1.1mm
D. 1.2mm
E. 1.5mm

正确答案：B。1.0mm

解析：烤瓷全冠肩台为1.0mm。掌握“烤瓷熔附金属冠”知识点。